某女，46岁。症见头痛昏重、胸膈痞闷、脘腹胀痛、呕吐泄泻，舌苔白腻。医师诊断为外感风寒、内伤湿滞证，处以藿香正气滴丸。处方组成：苍术160g、陈皮160g、姜厚朴160g、白芷240g、茯苓240g、大腹皮240g、生半夏160g、甘草浸膏20g、广藿香油1.6ml、紫苏叶油0.8ml。在《新型冠状病毒肺炎诊疗方案（试行第八版）》中，藿香正气滴丸被推荐用于医学观察期乏力伴胃肠不适的病例治疗。制备藿香正气滴丸时所用的聚乙二醇6000，其作用是
A. 起防腐作用
B. 作为滴丸的赋形剂
C. 调节制剂pH
D. 控制药物缓慢释放
E. 减少生半夏的刺激性

正确答案：B。作为滴丸的赋形剂

解析：本题考查的是滴丸的基质。制备藿香正气滴丸时所用的聚乙二醇6000，其作用是作为滴丸的赋形剂（B对）。滴丸的基质：滴丸基质有水溶性和非水溶性两大类：①水溶性基质，常用的有聚乙二醇类（如聚乙二醇6000、聚乙二醇4000等）、泊洛沙姆、硬脂酸聚烃氧（40）酯（商品名S-40）、明胶、甘油明胶、硬脂酸钠等；②非水溶性基质，常用的有硬脂酸、单硬脂酸甘油酯、氢化植物油、虫蜡、蜂蜡、十八醇等。根据需要，不同基质可配合使用，增加药物的溶解量，调节药物溶出或溶散时间，并有利于制备成型。